女，50岁。高热，寒战5天，意识模糊1天。既往体健。查体：T39℃，P120次/分，R22次/分，BP80/50mmHg，皮肤散在出血点和瘀斑，双肺未见异常，心率120次/分，律齐，腹软，肝肋下0.5cm，脾肋下及边。检查：Hb100g/L，WBC25.3×10⁹/L，血培养示大肠埃希菌生长，PT18秒（正常对照13秒），INR2.1，血纤维蛋白原定量108g/L。诊断为大肠埃希菌败血症，可能合并DIC。本例确诊DIC，需立即进行下列治疗，除了
A. 抗感染
B. 抗休克
C. 肝素抗凝
D. 抗纤溶
E. 输新鲜冰冻血浆

正确答案：D。抗纤溶

解析：患者确诊为大肠埃希菌败血症合并DIC，大肠埃希菌是引起DIC的基础病因，抗感染（A对）治疗是终止DIC病理过程最为关键和根本的治疗措施；患者出现意识模糊，血压80/50mmHg（正常值90/60mmHg），提示休克，应及时抗休克（B对）治疗挽救患者生命；抗凝治疗（C对）是终止DIC病理过程，减轻器官损伤，重建凝血-抗凝血平衡的重要措施，肝素是常用的抗凝药物；DIC患者常有凝血因子和血小板的过度消耗，应及时输注新鲜冰冻血浆（E对）等血液制品予以补充；抗纤溶治疗（D错，为本题正确答案）一般不使用，仅适用于去除病因及诱发因素并有明显纤溶亢进的临床及实验证据的患者。